瘀血流注证应首选的方剂是
A. 清暑汤
B. 托里透毒散
C. 五味消毒饮合透脓散
D. 活血散瘀汤
E. 黄连解毒汤合犀角地黄汤

正确答案：D。活血散瘀汤

解析：瘀血流注证证候：劳伤筋脉诱发者，多发于四肢内侧；跌打损伤诱发者，多发于伤处。局部漫肿疼痛，皮色微红，或呈青紫，溃后脓液中夹有瘀血块。妇女产后恶露停滞而成者，多发于小腹及大腿等处。发病较缓，初起一般无全身症状或全身症状较轻，化脓时出现高热。舌苔薄白或黄腻，脉涩或数。治法：和营祛瘀，清热化湿。方药：活血散瘀汤加减（D对）。暑湿流注证治法：清暑解毒化湿，方药：清暑汤（A错）。气血不足证，治法：消肿，溃脓，生肌，方药：托里透毒散（B错）。火毒结聚证，治法：清火解毒透脓，方药：五味消毒饮合透脓散加减（C错）。余毒流注证，治法：清热解毒，凉血通络，方药：黄连解毒汤合犀角地黄汤加减（E错）。